糖的特殊动力效应为
A. 0.04
B. 0.05
C. 0.06
D. 0.07
E. 0.08

正确答案：C。0.06